男，45岁。慢性肾小球肾炎，高血压病史3年。规律服用血管紧张素转换酶抑制剂和螺内酯治疗。1周前“上呼吸道感染”后出现尿量减少，近2天尿量约100ml/日。该患者最可能出现的电解质紊乱是
A. 血钾降低
B. 血镁降低
C. 血钙升高
D. 血钾升高
E. 血钠升高

正确答案：D。血钾升高

解析：中年男性患者，既往有慢性肾小球肾炎、高血压病史。规律服用血管紧张素转换酶抑制剂和螺内酯（分别为ACEI和保钾利尿剂，均易导致高钾血症）。1周前“上呼吸道感染”（感染易产生高钾血症）后出现尿量减少（急性肾损伤的表现），近2天尿量约100ml/日（正常尿量为1000～2000ml/d，＜400ml/d为少尿，＜100ml/d为无尿，提示患者接近无尿）。综合患者的病史、临床表现，考虑诊断为慢性肾小球肾炎急性肾损伤少尿期。患者肾功能受损，肾小球滤过率降低，肾小管排钾减少，且有诱发高钾血症的因素，最可能出现的电解质紊乱是血钾升高（D对A错）。少尿期其他常见电解质紊乱包括：①由于肾小球滤过率降低，肾脏排镁减少引起血镁升高（B错）；②由于钙摄入不足、活性维生素D缺乏、高磷血症、代谢性酸中毒等导致血钙降低（C错）；③水、钠潴留引起血钠降低（E错）。